抽搐伴高血压，肢体瘫痪，见于
A. 癔症
B. 破伤风
C. 脑血管疾病
D. 中毒性痢疾
E. 筋膜炎

正确答案：C。脑血管疾病

解析：抽搐伴高血压，肢体瘫痪，见于脑血管疾病（C对），脑血管疾病以骨骼肌痉挛为主要表现，可伴有血压升高。癔症（A错）是由明显的精神因素引起的一组疾病，表现为急性短暂的精神障碍、身体障碍，无器质性病变。破伤风（B错）表现为烦躁不安、局部疼痛、肌肉牵拉、抽搐及强直、苦笑面容。中毒性痢疾（D错）可出现高热、烦躁谵妄、反复惊厥、神志昏迷、大便腥臭等。筋膜炎（E错）主要表现为患处酸胀、沉重感、麻木感、僵硬、活动受限。